71岁，行动缓慢3年或者3月，近期右上肢无力，右手震颤，肢体肌张力上升，呈齿轮样，头核磁未见异常，诊断为什么疾病
A. 动脉硬化
B. 豆状核变性
C. 阿尔兹海默症
D. 帕金森
E. 扭转痉挛

正确答案：D。帕金森

解析：患者71岁，行动缓慢3年或者3月，近期右上肢无力，右手震颤，肢体肌张力上升，呈齿轮样（帕金森病的表现），头核磁未见异常，结合患者的表现，诊断为帕金森病（D对）。（P186）各种原因如动脉硬化、血管炎、先天性血管病、外伤、药物、血液病及各种栓子和血流动力学改变都可引起急性或慢性的脑血管疾病（A错）。肝豆状核变性是一种遗传性铜代谢障碍所致的肝硬化和以基底核为主的脑部变性疾病。临床特征为进行性加重的锥体外系症状、精神症状、肝硬化、肾功能损害及角膜色素环（K-F环）（B错）。痴呆是由于脑功能障碍而产生的获得性、持续性智能损害综合征，可由脑退行性变（如阿尔茨海默病、额颞叶变性等）引起，也可由其他原因（如脑血管病、外伤、中毒等）导致（C错）。扭转痉挛病变位于基底核，又称变形性肌张力障碍，表现为躯于和四肢发生的不自主的扭曲运动。躯干及脊旁肌受累引起的围绕躯干或肢体长轴的缓慢旋转性不自主运动是本症的特征性表现（E错）。以上四种疾病不会出现静止性震颤、运动迟缓、肌强直和姿势平衡障碍等表现。